各型天疱疮中出现口腔黏膜损害最少的是
A. 寻常型天疱疮
B. 增殖型天疱疮
C. 落叶型天疱疮
D. 红斑型天疱疮
E. 以上各型出现概率大致相同

正确答案：D。红斑型天疱疮

解析：本题考查口腔黏膜损害最少的天疱疮。各型天疱疮中出现口腔黏膜损害最少的是红斑型天疱疮（D对）。天疱疮是一类严重的、慢性的黏膜-皮肤自身免疫大疱性疾病。临床上根据皮肤损害特点可以分为寻常型、增值型、落叶型和红斑型四种类型，其中寻常型天疱疮（A错）发生于口腔黏膜损害最为多见。增值型天疱疮（B错）在口腔黏膜的表现基本同寻常型，但剥脱面出现明显的乳头状增生，表面隆起如沟裂状。落叶型天疱疮（C错）口腔损害少见，即使出现也多为不明显的小而浅的糜烂面。红斑型天疱疮是四种类型天疱疮累及口腔黏膜最少者，主要累及皮肤，皮损特点是红斑基础上的鳞屑并结痂。典型的损害区是位于两颊与跨越鼻梁的“蝶形”叶状损害。由此可知以上各型出现概率是不同的（E错）。